可出现胆囊显著肿大无压痛，伴黄疸进行性加重的疾病是
A. 急性胆囊炎
B. 慢性胆囊炎
C. 胆结石
D. 胆囊癌
E. 胰头癌

正确答案：E。胰头癌

解析：胰腺肿瘤如胰头癌或胰腺囊肿、胆管下端癌时，因胆总管阻塞，使黄疸明显加深，肝和胆囊因胆汁淤积而肿大，胆囊常可触及，但无压痛，故可出现胆囊显著肿大，无压痛，伴黄疸进行性加重的疾病是胰头癌（E对）。急性胆嚢炎（A错）、慢性胆囊炎（B错）、胆结石（C错）胆囊都会出现压痛，且黄疸不会进行性加重。胆囊癌（D错）患者可出现胆囊肿大，但是黄疸出现较晚，不呈进行性加重。